下列可摘局部义齿固位体必须具备的条件的是
A. 不损伤口内的软硬组织
B. 对基牙不应产生矫治性移位
C. 显露金属要少，不影响美观
D. 有固位作用，能保证义齿不致脱位
E. 以上说法均正确

正确答案：E。以上说法均正确

解析：固位体必须具备的条件1）有固位作用，能保证义齿不致脱位。2）对基牙不应产生矫治性移位。3）取戴义齿时，对基牙应无侧方压力，不损伤基牙。4）显露金属要少，不影响美观。5）不损伤口内的软硬组织。6）不易存积食物，以免造成余留牙龋坏和牙周炎症。7）固位体的颊、舌臂和各固位体间，尽量有交互对抗作用。掌握“局部义齿人工牙及基托”知识点。